硫酸镁用以治疗妊娠期高血压疾病时，下述哪项不对
A. 最主要用以解痉和降低神经兴奋性，以预防和控制抽搐
B. 24小时硫酸镁总量不得超过10g
C. 尿量少于17ml/h或呼吸＜16次/分时停用
D. 膝反射消失者禁用
E. 硫酸镁中毒时，用葡萄糖酸钙缓慢推注治疗之

正确答案：B。24小时硫酸镁总量不得超过10g

解析：硫酸镁每日总量为25～30克，用药过程中可监测血清镁离子浓度。掌握“娠期高血压疾病”知识点。